治疗虚劳肺气虚证，应首选的方剂是
A. 清燥救肺汤
B. 玉屏风散
C. 百合固金汤
D. 补肺汤
E. 当归补血汤

正确答案：D。补肺汤

解析：肺气亏虚，宣肃功能失职，气逆于上故见咳嗽无力；肺气亏虚，津液不布，聚为痰浊，故见痰液清稀；肺气亏虚，宗气生成减少故见短气自汗，声音低怯；气虚不能固表，故见时热时寒，平素易于感冒；气虚血脉不荣故见面白，舌淡，脉细软弱。诊断为虚劳之肺气虚证，治法：补益肺气。方药：补肺汤（D对）。痿证之肺热津伤，筋失濡养证，方药：清燥救肺汤（A错）。哮病缓解期肺虚证，宜补肺固卫，方药：玉屏风散（B错）。咯血之阴虚肺热证方药：百合固金汤（C错）。血劳脾胃虚弱证宜健脾和胃，益气养血，方药：当归补血汤（E错）。